根据《突发公共卫生事件应急条例》，卫生行政部门应当对医疗机构采取责令改正、通报批评、给予警告处理的情形是
A. 未建立突发事件信息发布制度
B. 未对突发事件开展流行病学调查
C. 未向社会发布突发事件信息
D. 未及时诊断不明原因疾病
E. 未履行突发事件报告职责

正确答案：E。未履行突发事件报告职责

解析：卫生行政部门应当对医疗机构采取责令改正、通报批评、给予警告处理的情形：①医疗卫生机构隐瞒、缓报、谎报的，未按规定履行报告职责（E对），由卫生行政部门责令改正、通报批评、给予警告；②县级以上各级人民政府卫生行政部门和其他有关部门在突发公共卫生事件调查、控制、医疗救治工作中玩忽职守、失职、渎职的，由本级人民政府或者上级人民政府有关部门责令改正、通报批评、给予警告；③县级以上各级人民政府有关部门拒不履行应急处理职责的，由同级人民政府或者上级人民政府有关部门责令改正、通报批评、给予警告；④医疗卫生机构未依照规定及时采取控制措施的、未履行突发公共卫生事件监测职责的、拒绝接诊病人的、拒不服从突发公共卫生事件应急处理指挥部调度的，由卫生行政部门责令改正、通报批评、给予警告。